巴氏消毒的温度范围为
A. 75～95℃
B. 63～95℃
C. 60～80℃
D. 65～95℃
E. 62～85℃

正确答案：E。62～85℃